下列哪一项不适于作颞下颌关节造影
A. 颞下颌关节脱位
B. 颞下颌关节有骨质改变及明显的间隙改变
C. 开闭口过程中有连续摩擦音
D. 发现有关节弹响、绞锁及明显的运动受限
E. 关节内占位性病变

正确答案：A。颞下颌关节脱位

解析：本题考查不适于作颞下颌关节造影的情况。颞下颌关节脱位多出现在大张口运动或下颌在张口时受到外伤，关节囊明显松弛、肌运动不协调时出现。X线片示髁突位于关节结节前上方。颞下颌关节脱位（A错，为本题的正确答案）通过临床症状及关节X线片即可诊断，不适于颞下颌关节造影。颞下颌关节有骨质改变及明显的间隙改变（B对）、开闭口过程中有连续摩擦音（C对）、发现有关节弹响、绞锁及明显的运动受限（D对）等属于颞下颌关节紊乱病的临床表现，关节造影可发现关节盘移位，关节间隙改变等，对颞下颌关节紊乱病的鉴别有重要意义。关节内占位性病变（E对）见于关节囊肿，造影检查对其有诊断价值。